男，15岁。四肢无力3天，伴吞咽困难1天，大小便正常，1周前腹泻2次，自服药物治疗好转。查体：神志清楚，构音障碍，双侧闭目无力、鼻唇沟浅、鼓腮不能，软腭无力，眼反射迟钝，腱反射消失，病理征未引出，双侧手袜子样感觉，腓肠肌压痛（+）。最可能的诊断是
A. 吉兰一巴雷综合征
B. 重症肌无力
C. 周期性瘫痪
D. 急性脊髓灰质炎
E. 多发性肌炎

正确答案：A。吉兰一巴雷综合征

解析：患者青少年男性，四肢无力3天，伴吞咽困难1天。查体：神志清楚，构音障碍，双侧闭目无力、鼻唇沟浅、鼓腮不能，软腭无力，眼反射迟钝，腱反射消失，病理征未引出，双侧手袜子样感觉，腓肠肌压痛（+）（吉兰-巴雷综合征的常见表现），综合病史和体查，考虑诊断为吉兰巴雷综合征（A对）。重症肌无力（B错）患者症状会有典型的“晨轻暮重”现象，会出现眼睑下垂等眼外肌麻痹表现，甚至会出现呼吸困难、吞咽困难等呼吸肌和口咽肌受累的表现。周期性瘫痪（C错）表现为四肢无感觉障碍周期性发作的迟缓性瘫痪，伴有低血钾。急性脊髓灰质炎（D错）表现为弛缓性瘫痪。多发性肌炎（E错）除了肌无力等表现为，还会出现皮疹等皮肤损害以及消化道、心脏、肾脏等多器官受损表现。